延缓普鲁卡因局部吸收的药物是
A. 肾上腺素
B. 异丙肾上腺素
C. 胰岛素
D. 去甲肾上腺素
E. 庆大霉素

正确答案：A。肾上腺素

解析：延缓普鲁卡因局部吸收的药物是肾上腺素（A对），加用肾上腺素后维持时间可延长20%。